我国贵州省部分地区居民习惯在室内燃煤、用煤火烘烤食物等，由此较易造成
A. 地方性镉中毒
B. 地方性氟中毒
C. 地方性甲状腺肿
D. 汞中毒
E. 多环芳烃中毒

正确答案：B。地方性氟中毒

解析：本题考查地方性氟中毒。地方性氟中毒是由于一定地区的环境中氟元素过多，而致生活在该环境中的居民经饮水、食物和空气等途径长期摄入过量氟所引起的以氟骨症和氟斑牙为主要特征的一种慢性全身性疾病。我国贵州省部分地区居民在室内燃煤、用煤火烘烤食物等，会严重污染室内空气和食品，居民吸入污染的空气和摄入污染的食品后会引起地方性氟中毒（B对ACDE错）。